男，60岁。嗜酒，急起高热，咳嗽，咳黏液脓性痰、量多，胸痛。胸片示右上肺叶实变，有多个蜂窝状空洞，叶间隙下坠。下列哪项诊断可能性最大
A. 肺炎球菌肺炎
B. 克雷伯杆菌肺炎
C. 金黄色萄萄球菌肺炎
D. 病毒性肺炎
E. 肺炎支原体肺炎

正确答案：B。克雷伯杆菌肺炎

解析：老年男性患者，嗜酒，急起高热，咳嗽，咳黏液脓性痰、量多，胸痛（克雷伯杆菌肺炎典型表现）。胸片示右上肺叶实变，有多个蜂窝状空洞，叶间隙下坠（典型X线征象），结合患者的症状、影像学检查，则诊断克雷伯杆菌肺炎（B对）可能性最大。肺炎球菌肺炎（A错）表现为起病急，寒战、高热、咳铁锈色痰、胸痛，X线征象为肺叶或肺段实变，无空洞，可伴胸腔积液。金黄色萄萄球菌肺炎（C错）表现为起病急，寒战、高热、脓血痰、气急、毒血症症状、休克，X线征象为肺叶或小叶浸润，早期空洞，脓胸，可见液气囊腔。病毒性肺炎（D错）好发于病毒性疾病流行季节，症状通常较轻，与支原体肺炎的症状相似。但起病较急，发热、头痛、全身酸痛、倦怠等全身症状较突出，常在急性流感症状尚未消退时即出现咳嗽、少痰或白色黏液痰、咽痛等呼吸道症状，X线征象为肺纹理增多，磨玻璃状阴影，小片状浸润或广泛浸润、实变，病情严重者显示双肺弥漫性结节性浸润，但大叶实变及胸腔积液者均不多见。肺炎支原体肺炎（E错）起病缓慢，起初有数天至一周的无症状期，继而乏力、头痛、咽痛、肌肉酸痛，咳嗽明显，多为发作性干咳，夜间为重，也可产生脓痰，持久的阵发性剧咳为支原体肺炎较为典型的表现，X线征象为肺部多种形态的浸润影，呈节段性分布，以肺下野为多见，有的从肺门附近向外伸展。病变常经3~4周后自行消散。部分病人出现少量胸腔积液。